脊髓灰质的描述，哪项错误
A. 呈“蝶”形或“H”形
B. 位于中央管周围，被白质包绕
C. 前部扩大，称前角（柱）
D. 后部狭长，称后角（柱）
E. 前、后角间均由侧角相连

正确答案：E。前、后角间均由侧角相连

解析：在脊髓的横切面上，可见位于中央管周围，被白质包绕（B对），呈“蝶”形或“H”形（A对）的灰质，每侧的灰质，前部扩大为前角（柱）（C对）;后部狭细为后角（柱）（D对），灰质前、后联合连接前、后角（E错，为本题正确选项）。